四环素牙萌出时呈
A. 亮蓝色
B. 亮黄色
C. 乳白色
D. 透明色
E. 亮绿色

正确答案：B。亮黄色

解析：四环素受累牙萌出时呈现了亮黄色。掌握“四环素牙”知识点。